益母草可用于
A. 小便不利，水肿
B. 心悸怔忡，失眠
C. 风寒头痛，风湿痹痛
D. 湿浊蒙窍，神志不清
E. 阴虚火旺，齿痛口疮

正确答案：A。小便不利，水肿

解析：本题考查的是益母草的主治病证。益母草可用于小便不利，水肿（A对）。益母草：【主治病证】（1）月经不调，痛经，闭经，产后瘀阻腹痛，跌打伤痛。（2）小便不利，水肿。（3）疮痈肿毒，皮肤痒疹。丹参：【主治病证】（1）月经不调，血滞闭经，产后瘀滞腹痛。（2）胸痹心痛，脘腹疼痛，癥瘕积聚，肝脾肿大，热痹肿痛。（3）热病高热烦躁，内热心烦，斑疹，心悸怔忡，失眠（B错）。（4）疮痈肿痛。川芎：【主治病证】（1）月经不调，痛经，闭经，难产，产后瘀阻腹痛。（2）胸痹心痛，胁肋作痛，肢体麻木，跌打损伤，疮痈肿痛。（3）头痛，风湿痹痛（C错）。郁金：【性能特点】本品辛行散，苦泄降，寒清凉，入心、肝、胆、肺经。走血走气，既活血止痛，又疏肝行气解郁，还清心凉血而止血、醒神、利胆退黄，为活血行气凉血之要药。凡血瘀气滞有热、肝郁化火、血热出血、热扰心神及湿热郁闭心窍（D错），皆可酌选。【主治病证】（1）胸腹胁肋胀痛或刺痛，月经不调，痛经，癥瘕痞块。（2）热病神昏，癫痫发狂。（3）血热之吐血、衄血、尿血，妇女倒经。（4）湿热黄疸，肝胆或泌尿系结石症。牛膝：【主治病证】（1）月经不调，痛经，闭经，难产，产后瘀阻腹痛，癥瘕，跌打伤痛。（2）小便不利，淋证涩痛，湿热下注之足膝肿痛。（3）吐血，衄血，牙龈肿痛，口舌生疮（E错）。（4）肝阳上亢之头痛眩晕。（5）肝肾亏虚之腰膝酸痛、筋骨无力，风湿痹痛，筋脉拘挛，痿证。